某一细胞群体杀伤肿瘤细胞机制为，释放溶酶体直接杀伤、ADCC效应、分泌TNF等细胞因子。该细胞是
A. Mφ
B. NK
C. Tc
D. LAK
E. TIL

正确答案：A。Mφ

解析：Mφ是巨噬细胞，在抗肿瘤免疫中，杀伤肿瘤的机制有：①与肿瘤细胞结合后通过释放溶酶体直接杀伤肿瘤细胞；②处理肿瘤抗原，并通过产生IL-1和IL-12等激活T细胞；③通过特异性IgGFc受体介导ADCC效应；④分泌TNF、一氧化氮等间接杀伤肿瘤细胞。掌握“肿瘤免疫”知识点。